可妨碍牙髓治疗的是
A. 牙髓治疗
B. 牙髓息肉
C. 髓石
D. 弥漫性钙化
E. 成牙本质细胞空泡性变

正确答案：C。髓石

解析：本题考查牙髓治疗的影响因素。髓石（C对）大小形态及数目不等，可游离于髓腔，也可附着在髓腔壁，大者可充满整个髓腔，有时影响根管治疗。弥漫性钙化（D错）是牙髓钙化的一种形式，可造成整个髓腔闭锁，增加牙髓治疗难度。牙髓息肉（B错）是慢性增生性牙髓炎患牙中大而深的龋洞中，呈红色、“蘑菇”形状的息肉样肉芽组织。牙髓治疗（A错）是关于牙髓的治疗，本身不会妨碍到治疗。成牙本质细胞空泡性变（E错）指成牙本质细胞间液体积聚形成水泡，常因牙髓血供不足、细菌及其毒素刺激、洞形制备的创伤或刺激性充填材料的刺激等所引起。